属药剂学配伍变化中物理配伍变化现象的有
A. 因某成分在混合液体中的溶解度减小而出现浑浊或析出沉淀
B. 因配伍而使混合物的临界相对湿度下降，在制备、应用或贮存中发生的吸湿、潮解或液化
C. 硫酸锌在弱碱性溶液中析出沉淀
D. 胶体溶液中的胶体微粒因加入脱水剂而凝聚沉淀
E. 混悬液中的混悬微粒因聚集而增大变粗

正确答案：A、B、D、E。因某成分在混合液体中的溶解度减小而出现浑浊或析出沉淀；因配伍而使混合物的临界相对湿度下降，在制备、应用或贮存中发生的吸湿、潮解或液化；胶体溶液中的胶体微粒因加入脱水剂而凝聚沉淀；混悬液中的混悬微粒因聚集而增大变粗

解析：本题考查药剂学的物理配伍变化。属药剂学配伍变化中物理配伍变化现象的有：因某成分在混合液体中的溶解度减小而出现浑浊或析出沉淀（A对）、因配伍而使混合物的临界相对湿度下降，在制备、应用或贮存中发生的吸湿、潮解或液化（B对）、胶体溶液中的胶体微粒因加入脱水剂而凝聚沉淀（D对）、混悬液中的混悬微粒因聚集而增大变粗（E对）。物理配伍变化，是指制剂在配伍制备、贮存过程中，发生了物理性质的改变，从而影响制剂的外观或内在质量的变化。例如醇性制剂中的树脂在水性制剂中由于溶解度降低而析出；含低共熔成分的制剂久贮结聚而丧失干燥均匀的状态；剂量较小的生物碱盐与吸附性较强的固体粉末（如活性炭、白陶土等）配伍时，前者被后者吸附而减少在机体中的释放等。物理配伍变化：（1）溶解度的改变：1.温度改变。2.药渣吸附。3.盐析作用。4.增溶作用。5.改变溶剂，不同溶剂的液体制剂配合在一起，常会析出沉淀。6.贮藏过程。（2）吸湿，潮解、液化与结块：1.吸湿与潮解2.液化3.结块。（3）粒径或分散状态的改变：中药制剂组分或制剂本身的粒径或分散状态改变可直接影响制剂的质量。例如乳剂、混悬剂中分散相的粒径可因与其他药物配伍而变大，分散相聚结、凝聚或分层，导致使用不便或分剂量不准，甚至影响药物在体内的吸收。胶体溶液可因加人电解质或其他脱水剂使胶体分散状态破坏而产生沉淀。某些保护胶体中加人浓度较高的亲水物质如糖、乙醇或强电解质可使保护胶失去作用。